上皮棘层松解的定义是
A. 棘层细胞排列疏松，形成棘层内疱
B. 棘层细胞数目减少，液体聚集
C. 棘层细胞间桥溶解，形成棘层裂隙
D. 棘层细胞水肿，形成松散结构
E. 棘层细胞间桥增粗，细胞减少

正确答案：C。棘层细胞间桥溶解，形成棘层裂隙

解析：棘层松解是由于上皮棘层细胞间张力原纤维及黏合物质发生变性、断裂破坏，细胞间桥溶解，而使棘细胞间联系力松弛、断裂，严重时失去联系、解离，则在棘层形成裂隙或疱。此种病变见于天疱疮等。掌握“口腔黏膜基本病理变化”知识点。